疾病的三间分布的存在方式及其发生、发展规律是指在
A. 时间、空间、人间
B. 世间、空间、期间
C. 空间、世间、人间
D. 人间、期间、空间
E. 世间、时间、人间

正确答案：A。时间、空间、人间

解析：疾病三间分布：疾病的分布是指疾病在时间、空间和人间的存在方式及其发生、发展规律，又称疾病的三间分布。掌握“流行病学资料与疾病分布”知识点。